主要用扭转力拔除的牙是
A. 上颌第三磨牙
B. 下颌中切牙
C. 上颌尖牙
D. 上颌前磨牙
E. 下颌前磨牙

正确答案：C。上颌尖牙

解析：本题考查各类牙拔除术。主要用扭转力拔除的牙是上颌尖牙（C对）。摇动是使牙松动的主要方式，主要适用于扁根的下颌前牙、前磨牙和多根的磨牙；扭转主要适用于圆锥形的单根牙，如上颌中切牙和尖牙；牵引是使患牙自牙槽窝中脱出必需的、直接的力量，一般是使患牙脱位的最后步骤，适用于任何类型的牙。1.上颌第三磨牙（A错）牙根变异较大，但多数为单根或颊、腭两根，一般向远中弯曲，周围的骨质疏松，远中为上颌结节，拔除相对较易。可用牙挺向后、下、外方施力，多可拔除；用牙钳在摇动的基础上，向下、远中颊侧牵引。应注意防止断根及上颌结节骨折。2.下颌切牙（B错）牙冠小，牙根扁平而细短，近远中径小。多为直根，唇及舌侧骨板均薄，尤以唇侧更甚。脱位运动先摇动后，向唇侧上方牵引。不宜使用扭转。牵引时应用左手拇指控制牙钳，防止碰伤对颌牙。3.上颌前磨牙（D错）是扁根，断面呈颊腭径宽的哑铃状。上颌第一前磨牙常在根尖1/3或1/2处分为颊、腭两个较细易断的根；第二前磨牙多为单根，颊侧骨壁较腭侧薄。拔除时先向颊侧小幅度摇动，感到阻力较大后，转向腭侧，逐渐增大幅度，同时向颊侧远中牵引。该牙拔除不宜使用扭转力，以免断根。4.下颌第一、第二前磨牙（E错）解剖形态近似，均为锥形单根，有时根尖向远中略弯，横断面为颊舌径大的扁圆形，颊侧骨板较薄。拔牙动作主要为颊舌向摇动，辅以小幅度的扭转，最后向上、颊侧、远中方向牵引。